患者，男，28岁。左下第三磨牙近中阻生，左下第二磨牙远中颈部深龋，患者自述左下后牙冷热刺激疼痛，刺激去除后，无其他不适，无自发性疼痛。如患者右侧新萌出第三磨牙，下列哪种情况不需要拔除
A. 反复引起冠周炎症
B. 可能为颞下颌关节紊乱病诱因
C. 引起第二磨牙牙周病变
D. 因正畸需要
E. 完全骨阻生，无症状者

正确答案：E。完全骨阻生，无症状者

解析：本题考查阻生牙拔除术。第三磨牙完全骨阻生，无症状者（E错，为本题正确答案）不需要拔除。下颌阻生第三磨牙拔除术的适应证：反复引起冠周炎症者（A对）；本身有龋坏，或引起第二磨牙牙体、牙周病变者（C对）；因正畸需要时（D对）；可能为颞下颌关节紊乱病诱因者（B对）；因完全骨阻生而被疑为原因不明的神经痛病因者或可疑为病灶牙者；已引起牙源性囊肿或肿瘤；因压迫导致第二磨牙牙根中远中骨吸收；引起第二磨牙与第三磨牙直接食物嵌塞。